小肠
A. 包括十二指肠、空肠和回肠
B. 空肠占其全长的3/5
C. 均借肠系膜连于腹后壁
D. 肠壁内有丰富的集合淋巴滤泡
E. 均属腹膜内位器官

正确答案：A。包括十二指肠、空肠和回肠

解析：小肠包括十二指肠、空肠和回肠(A对)，空肠占全长的2/5(B错)，空回肠借肠系膜系于腹后壁而十二指肠上无系膜(C错)，集合淋巴滤泡多位于回肠下部(D错)，十二指肠中除始末两端其他均为腹膜外位器官(E错)。